代偿期肝硬化下列哪项正确
A. 皮肤色素沉着
B. 男性乳房发育
C. 肝功轻度损害
D. 脾功能亢进
E. 贫血

正确答案：C。肝功轻度损害